具有较强的中枢抑制作用，临床常用于预防晕动症的药物是
A. 氯雷他定
B. 富马酸酮替芬
C. 盐酸苯海拉明
D. 盐酸西替利嗪
E. 盐酸赛庚啶

正确答案：C。盐酸苯海拉明

解析：本题考查H₁受体拮抗剂的作用特点。盐酸苯海拉明（C对）是抗组胺药，具有抗组织胺H₁受体的作用，对中枢神经有较强的抑制作用，还有阿托品样的作用，使用于皮肤黏膜的过敏性疾病，比如荨麻疹、枯草热、过敏性鼻炎等。还可以用于预防晕车、晕船、晕飞机等晕动症。